严重低血钾引起
A. 盐水反应性碱中毒
B. 盐水抵抗性碱中毒
C. 两者均有
D. 两者均无
E. 无

正确答案：B。盐水抵抗性碱中毒

解析：低钾血症时因细胞外k+浓度降低，引起细胞内k+向细胞外转移，同时细胞外的H+向细胞内移动，可发生代谢性碱中毒，此时给予盐水不能改善缺钾状态而没有治疗效果，故严重低血钾引起盐水抵抗性碱中毒（B对）。